三岁患儿上楼梯时，其父向上牵拉右上肢，患儿哭叫，诉肘部疼痛，不肯用右手取物，最可能的诊断是
A. 肘关节脱位
B. 桡骨头骨折
C. 桡骨头半脱位
D. 肌肉牵拉伤
E. 尺骨鹰嘴撕脱伤

正确答案：C。桡骨头半脱位

解析：患儿有右上肢牵拉史，肘部疼痛，不肯用右手取物，结合患者病史和临床表现，其最可能的诊断是桡骨头半脱位（C对）。肘关节脱位（A错）主要表现为肘后突畸形、肘后三角关系改变。桡骨头骨折（B错）多有外伤史，可出现骨折特有体征（畸形、异常活动、骨擦音或骨擦感）。肌肉牵拉伤（D错）指肌肉在运动中急剧收缩或过度牵拉引起的损伤。尺骨鹰嘴撕脱伤（即尺骨鹰嘴撕脱骨折）（E错）多见于成人，多有明显的外伤史。